下列选项中是塑料制品中单体毒性较大的有
A. 聚苯乙烯
B. 聚氯乙烯
C. 聚乙烯
D. 聚丙烯
E. 丙乙酰胺

正确答案：B。聚氯乙烯

解析：本题考查氯乙烯的单体。聚氯乙烯（B对ACDE错）的单体是氯乙烯，氯乙烯有致癌作用。